根据五行理论，肝病传肺的病机是
A. 相克
B. 相乘
C. 相侮
D. 母病及子
E. 子病犯母

正确答案：C。相侮

解析：本题考查的是相侮传变。根据五行理论，肝病传肺的病机是相侮（C对）。相侮传变，即反克为害而致的疾病传变。肺金本克肝木，当肝木之气太过，或肺金之气太弱时，肺金不仅不能克制肝木，反为肝木所克。如木火刑金的肝火犯肺证，临床见胸胁胀痛、口苦、烦躁易怒、脉弦数等肝火亢盛之症，又相继出现咳嗽、气逆，甚至咯血，或痰中带血等肺失清肃之症。五行相克（A错）是指木、火、土、金、水之间存在着有序的递相克制、制约的关系。五行之间递相制约的次序是：木克土，土克水，水克火，火克金，金克木。相乘（B错）传变，即相克太过而致的疾病传变。如肝病的实证，肝木之郁实，可克伐属土的脾胃，即肝病传脾。临床上肝气郁结证，症见烦躁易怒、胸胁闷痛、月经不调等；横逆于脾，出现肝脾不和，又见脘腹胀满、纳呆不欲食、大便溏泄或不调等症；横逆于胃，出现肝胃不和，又见呕吐、嗳气、吞酸、纳呆等症。脾病的实证，脾土之湿盛，可克伐属水的肾和膀胱，导致水湿运化不能，肾与膀胱气化不利，水湿内停，见身体困重、小便不利、全身浮肿、纳呆、舌苔滑腻等症。母病及子（D错），又称“母病累子”。病从母脏传来，先见母脏病证，继见子脏病证。如临床常见的“水不涵木”证，肾阴亏虚，肝阴失养，导致阴不能制阳，肝阳亢逆之证，症见腰酸软、眩晕耳鸣、遗精、健忘、失眠、烦躁易怒、口燥咽干、盗汗、颧红、五心烦热等。其病从肾传至肝，阴虚阳亢为病变的本质。子病及母，包括“子病犯母（E错）”和“子盗母气”。病从子脏传来，先见子脏病证，继见母脏病证。如临床常见的心肝火旺证，可因心火亢盛，导致肝火上炎，症见心悸、失眠、口舌生疮，甚至谵语、狂躁，又见烦躁易怒、头痛眩晕、面红目赤等。其病从心传肝，火热实盛是其病变本质。